血红素合成障碍所致的贫血
A. 再生障碍性贫血
B. 缺铁性贫血
C. 巨幼细胞贫血
D. 海洋性贫血
E. 自身免疫性溶血性贫血

正确答案：B。缺铁性贫血

解析：铁是血红素合成的原料，缺铁和铁利用障碍都会影响血红素的合成。缺铁性贫血（B对）时，血红素合成原料铁缺乏，大量原卟啉不能与铁结合成为血红素，导致血红素合成障碍，继而造成血红蛋白生成减少，引起贫血。再生障碍性贫血（P547）（A错）是因多种机制和病因引起的骨髓造血功能衰竭所致的贫血；巨幼细胞贫血（P544）（C错）主要是因叶酸或维生素B₁₂缺乏导致DNA合成障碍所致的贫血。海洋性贫血（P555）（D错）是因遗传性珠蛋白生成障碍引起的溶血性贫血；自身免疫性溶血性贫血（P557）（E错）是因自身抗体导致的溶血性贫血，溶血性贫血属于红细胞破坏过多引起的贫血。